作用于神经氨酸酶的抗流感病毒药物是
A. 阿昔洛韦
B. 利巴韦林
C. 奥司他韦
D. 膦甲酸钠
E. 金刚烷胺

正确答案：C。奥司他韦

解析：本题考查非核苷类抗病毒药。奥司他韦（C对）是作用于神经氨酸酶的抗流感病毒药物，通过抑制NA（去甲肾上腺素），能有效地阻断流感病毒的复制过程，对流感的预防和治疗发挥重要的作用。阿昔洛韦（A错）为核苷类抗病毒药；利巴韦林（B错）、金刚烷胺（E错）为非核苷类抗病毒药。膦甲酸钠（D错）为无机焦磷酸盐的有机类似物，可抑制包括巨细胞病毒、单纯疱疹病毒1型和2型等疱疹病毒的复制。